患者女性，45岁，因左侧腮腺肿物局麻下行左侧腮腺浅叶及肿物切除术，术后局部应用绷带加压包扎，最好选用
A. 三角带
B. 四头带
C. 头颅弹性绷带
D. 交叉十字绷带
E. 单眼交叉绷带

正确答案：D。交叉十字绷带

解析：本题考查常用绷带类型及应用。患者女性，45岁，因左侧腮腺肿物局麻下行左侧腮腺浅叶及肿物切除术，术后局部应用绷带加压包扎，最好选用交叉十字绷带（D对）。常用绷带类型：1.四头带（B错）：亦称四尾带。其用途如下：（1）包扎鼻部创口；（2）包扎下颌、颏部创口；（3）压迫术后创口。2.十字交叉绷带：被广泛用于颌面部（例如耳前区、耳后区、腮腺区、下颌下区、颏下区）和上颈部术后和损伤的包扎固定。3.巴唐绷带：类似于十字交叉绷带。自顶部开始，经一侧耳前绕颏部至对侧耳前，再越顶部回至同侧耳上反折，行额枕环绕1圈再回至同侧，继续绕枕部经对侧下颌体，包绕颏部再回到同侧枕部。如欲多缠绕几圈加固，则可反复循此途径进行。4.面部绷带：亦称单眼交叉绷带（E错），常用于上颌骨、面、颊部手术后的创口包扎。5.头部绷带（C错）：主要用子头皮部手术，如皮瓣转移、游离植皮以及颅颌根治术后等。目前临床上已有各种型号的成品弹力网帽供选择使用。6.颈部绷带：基本上是螺旋形包扎法。这种绷带过紧，极易压迫呼吸道。因此，全麻术后患者应用时要特别注意松紧适度。利用宽胶布从颈后向颈前、胸部作交叉粘贴固定敷料，对颈中、下部手术很适用，但压力稍轻。7.颈腋8字绷带：主要用于颈淋巴清扫术后，特别对压迫锁骨上死腔有效。8.医用弹力套：使用时以颏部为基点，开孔对准并露出双侧耳廓，分别将弹力绷带向头顶、枕部和颈后方向拉伸，调整松紧度后粘贴，以达到加压包扎的目的。